要获得某个地区儿童少年生长发育的正常值，应选择下列哪个学校
A. 普通中小学校
B. 舞蹈学校
C. 体育学校
D. 武术学校
E. 聋哑学校

正确答案：A。普通中小学校